同侧眼鼻侧偏盲和对侧眼颞侧偏盲，损伤的部位在
A. 外侧膝状体
B. 视束
C. 视辐射
D. 视觉中枢
E. 以上都是

正确答案：E。以上都是

解析：当视觉传导通路的不同部位受损时，可引起不同的视野缺损，一侧视束及以后的视觉传导路（视辐射、视区皮质）受损，可致双眼病灶对侧半视野同向性偏盲（如右侧受损则右眼视野鼻侧半和左眼视野颞侧半偏盲），所以同侧眼鼻侧偏盲和对侧眼颞侧偏盲，损伤的部位在一侧视束（B对）及以后的视觉传导路即视辐射（C对）、外侧膝状体（A对）、视觉中枢（D对，E为本题正确答案）。